关于牙髓病和根尖周病的治疗哪一点是错误的
A. 根管治疗时，不宜反复封药
B. 剧烈疼痛的急性牙髓炎口服止痛药很难奏效
C. 氢氧化钙制剂亦可用于根管消毒
D. 不需要等到一切症状都消失后才做根管充填
E. 牙髓病和根尖周病多由于细菌感染引起，因此治疗时可不强调无菌操作

正确答案：E。牙髓病和根尖周病多由于细菌感染引起，因此治疗时可不强调无菌操作

解析：本题考查牙髓病和根尖周病的治疗。牙髓病和根尖周病虽多由细菌感染引起，根管中有不少细菌但是根管治疗时要严格无菌操作（E错，为本题的正确答案），避免将新的细菌带入根管，引起炎症反复发作。牙髓病和根尖周病根管治疗时，不宜反复封药（A对），否则会使根管带入新的细菌，导致难治性根尖周炎。剧烈疼痛的急性牙髓炎口服止痛药很难奏效（B对），此时髓腔压力极高，需在局麻下开髓引流才能缓解疼痛。氢氧化钙呈强碱性可以抑制细菌产酸，从而达到消炎抑菌的作用，因此可用于根管消毒（C对）。根管充填可以消除根管消毒后残留的炎症，因此不需等到一切症状完全消失后做根管充填（D对），轻微病变在根充后可以愈合消失。